柴胡具有的功效是
A. 疏散风热，清利头目
B. 疏散风热，息风止痉
C. 疏散风热，解毒透疹
D. 疏散风热，平肝明目
E. 疏散风热，疏肝解郁

正确答案：E。疏散风热，疏肝解郁

解析：柴胡苦辛微寒，芳香疏泄，轻清升散，入肝、胆经。既疏散少阳半表半里之邪而和解退热，又条达肝气而疏肝解郁、调经止痛，且能升发清阳而举陷，为和解少阳、疏肝解郁调经及升阳举陷之要药。功效疏散退热，疏肝解郁，升举阳气（E对）。疏散风热，清利头目（A错）是薄荷的功效。疏散风热，息风止痉（B错）是蝉蜕的功效。疏散风热，解毒透疹（C错）是牛蒡子的功效。疏散风热，平肝明目（D错）是菊花、桑叶的功效。